大于胎龄儿是指出生体重在同胎龄体重多少百分位数以上
A. 90
B. 80
C. 85
D. 70
E. 75

正确答案：A。90

解析：本题考查体重与胎龄的关系分类。大于胎龄儿时新生儿出生体重在同胎龄平均出生体重的第90百分位以上（A对BCDE错）。根据出生体重与胎龄关系分类：1.适于胎龄儿是新生儿的出生体重在同胎龄平均出生体重的第10～90百分位之间；2.小于胎龄儿是新生儿出生体重在同胎龄平均出生体重的第10百分位以下；3.大于胎龄儿时新生儿出生体重在同胎龄平均出生体重的第90百分位以上。